下列为DNA损伤后修复的过程，例外的是
A. 切除修复
B. 重组修复
C. 置换修复
D. 直接修复
E. 损伤跨越修复

正确答案：C。置换修复